急性职业中毒的主要治疗原则是
A. 迅速脱离现场
B. 阻止毒物继续吸收、解毒及排毒
C. 对症处理与支持疗法
D. 保护重要器官的功能
E. 增强机体的抵抗力

正确答案：B。阻止毒物继续吸收、解毒及排毒

解析：本题考查急性职业中毒的治疗原则。当面临急性职业中毒时，应进行以下步骤：①现场急救；②阻止毒物继续吸收；③解毒和排毒（B对ACDE错）；④对症治疗。